6位侧链为苯氧丙酰基，耐酸性较强，可口服，主要用于治疗肺炎、咽炎、扁桃体炎等感染性疾病的药物是
A. 羧苄西林
B. 非奈西林
C. 苯唑西林
D. 阿度西林
E. 哌拉西林

正确答案：B。非奈西林

解析：本题考查非奈西林。6位侧链为苯氧丙酰基，耐酸性较强，可口服，主要用于治疗肺炎、咽炎、扁桃体炎等感染性疾病的药物是非奈西林（B对）。羧苄西林（A错）是将氨苄西林分子氨基以羧基替代得到，主要用于铜绿假单胞菌、大肠埃希菌等引起的感染。苯唑西林（C错）是用3-苯基-5-甲基异噁唑取代甲氧西林的二甲氧基苯得到的药物，耐酶、耐酸，主要用于耐青霉素葡萄球菌所致的各种感染。阿度西林（D错）6位侧链具有吸电子的叠氮基团，对酸稳定，口服吸收良好，其抗菌作用与用途类似青霉素V。哌拉西林（E错）是在氨苄西林6位侧链的氨基上引入极性较大的哌嗪酮酸基团的衍生物，抗假单胞菌，对革兰阳性菌的作用与氨苄西林相似。